既杀虫，又消积的药有
A. 槟榔
B. 雷丸
C. 苦楝皮
D. 使君子
E. 鹤草芽

正确答案：A、B、D。槟榔；雷丸；使君子

解析：本题考查槟榔、雷丸、使君子的功效。既杀虫，又消积的药有槟榔（A对）、雷丸（B对）、使君子（D对）。槟榔【功效】杀虫，消积，行气，利水，截疟。雷丸【功效】杀虫，消积。使君子【功效】杀虫消积。苦楝皮（C错）【功效】杀虫，疗癣。鹤草芽（E错）【功效】杀虫。